属于前药，在体内水解成原药后发挥解热镇痛及抗炎作用的药物是
A. 阿司匹林
B. 对乙酰氨基酚
C. 贝诺酯
D. 塞来昔布
E. 布洛芬

正确答案：C。贝诺酯

解析：本题考查药物的作用。贝诺酯（C对）为对乙酰氨基酚与阿司匹林形成的酯的前药，相对的胃肠道反应小，在体内水解成原药，具有解热、镇痛及抗炎作用。阿司匹林（A错）为环氧合酶（COX）的不可逆抑制剂，可以使COX发生乙酰化反应而失去活性，从而阻断前列腺素等内源性致热致炎物质的生物合成，起到解热、镇痛、抗炎的作用。对乙酰氨基酚（B错）通过抑制下丘脑体温调节中枢前列腺素合成酶，减少前列腺素PGE₁、缓激肽和组胺等的合成和释放，其抑制中枢神经系统前列腺素合成的作用与阿司匹林相似，但抗炎作用较弱。塞来昔布（D错）是选择性抑制COX-2的非甾体抗炎药，COX-2存在于人体脑部和肾脏等处，具有影响电解质代谢和血压的生理作用，而COX-1抑制剂具有心血管保护作用。COX-2抑制剂在阻断前列环素产生的同时，并不能抑制血栓素的生成，有可能会打破体内促凝血和抗凝血系统的平衡，从而在理论上会增加心血管事件的发生率。布洛芬（E错）（S）-异构体的活性比（R）-异构体强28倍，但布洛芬通常以外消旋体上市，因为布洛芬在体内会发生手性异构体间转化，无效的（R）-异构体可转化为有效的（S）-异构体。